女，28岁。低热、干咳2周。胸部X线片示右侧中等量胸腔积液。胸腔积液检查示有核细胞总数1460×10⁶/L，单核细胞0.85。给予四联抗结核药物治疗。下列对防止该患者出现胸膜肥厚最重要的措施是
A. 胸腔内注射糖皮质激素
B. 胸腔内注射抗结核药物
C. 口服糖皮质激素
D. 胸腔内注射尿激酶
E. 反复胸腔穿刺抽取胸腔积液

正确答案：E。反复胸腔穿刺抽取胸腔积液

解析：患者青年女性，低热、干咳2周。胸部X线片示右侧中等量胸腔积液。胸腔积液检查示有核细胞总数1460×10⁶/L（正常＜500×10⁶/L，提示渗出性积液），单核细胞0.85（正常值0.5～0.75）。给予四联抗结核药物治疗。结合患者症状及实验室检查，考虑为结核性胸腔积液。患者中等量胸腔积液，可反复胸腔穿刺抽取胸腔积液（E对），以减轻或解除胸腔积液对心肺的压迫症状，减少纤维蛋白沉着和减轻胸膜增厚。胸腔内注射糖皮质激素（A错）适用于有炎症反应的胸膜炎治疗。胸腔内注射抗结核药物（B错）适用于结核性胸膜炎。口服糖皮质激素（C错）适用于抗炎和免疫抑制治疗。胸腔内注射尿激酶（D错）适用于脓胸的治疗。